属于B细胞缺陷病
A. 慢性肉芽肿
B. DiGeorge综合征
C. Bruton病
D. SCID
E. 补体系统缺陷

正确答案：C。Bruton病